根据《中华人民共和国药品管理法实施条例》《医疗机构制剂许可证》的许可事项发生变更的，提出变更登记申请期限为许可事项发生变更
A. 15日前
B. 30日前
C. 60日前
D. 3个月
E. 6个月

正确答案：B。30日前

解析：本题考查医疗机构的药剂管理。根据《中华人民共和国药品管理法实施条例》《医疗机构制剂许可证》的许可事项发生变更的，提出变更登记申请期限为许可事项发生变更30日前（B对）。《中华人民共和国药品管理法实施条例》第二十一条规定，医疗机构变更《医疗机构制剂许可证》许可事项的，应当在许可事项发生变更30日前，按照《中华人民共和国药品管理法实施条例》向原审核，批准机关申请《医疗机构制剂许可证》变更登记；未经批准，不得变更许可事项。原审核、批准机关应当在各自收到申请之日起15个工作日内作出决定。